使第2、4、5指内收
A. 掌长肌
B. 蚓状肌
C. 骨间掌侧肌
D. 骨间背侧肌
E. 鱼际肌

正确答案：C。骨间掌侧肌

解析：掌长肌（A错）屈腕，紧张掌腱膜。蚓状肌（B错）既能屈第2～5掌指关节又能伸指骨间关节。骨间掌侧肌（C对）内收2、4、5指，屈第2、4、5指掌指关节和伸其指骨间关节。骨间背侧肌（D错）固定第3指，外展第2、4指，屈第2～4指掌指关节和伸其指骨间关节。鱼际肌（E错）是手肌外侧群4块肌肉的合成，无使第2、4、5指内收的功能。